代表了釉质周期性生长的速率
A. 釉丛
B. 釉梭
C. 釉板
D. 釉牙本质界
E. 釉质生长线

正确答案：E。釉质生长线

解析：本题考查釉质生长线。与釉质周期性生长相关的结构为横纹和生长线（E对），釉质生长线约代表5～10天釉质沉积的厚度。釉丛是在磨片上近釉质牙本质界内1/3的釉质中，类似于草丛的结构（A错）。釉梭是起始于釉牙本质交界伸向釉质的纺锤状结构，形成于釉质发生的早期（B错）。釉板是片状、贯穿整个釉质厚度的结构缺陷，自釉质表面延伸至釉质不同的深度，可达釉牙本质界（C错）。釉牙本质界为来自上皮和外间充质两种不同矿化组织的交界面（D错）。